能松弛支气管及减轻支气管黏膜水肿的药物是
A. 肾上腺素
B. 阿托品
C. 异丙肾上腺素
D. 多巴胺
E. 去甲肾上腺素

正确答案：A。肾上腺素

解析：肾上腺素（A对）主要激动α和β受体，作用与机体的生理病理状态、靶器官中肾上腺素受体亚型的分布、整体的反射作用和神经末梢突出间隙的反馈调节等因素有关，可激动支气管平滑肌β₂受体，发挥强大的舒张支气管作用，激动支气管粘膜血管的α受体，使其收缩，降低毛细血管的通透性，有利于消除支气管黏膜水肿。